茶碱类主要用于治疗
A. 支气管哮喘
B. 支气管扩张
C. 气管炎
D. 肺不张
E. 慢性阻塞性肺炎

正确答案：A。支气管哮喘

解析：当急性哮喘病例在吸入β₂受体激动药疗效不显著时，可用静脉注射茶碱，以收到相加作用的疗效。茶碱主要用于慢性哮喘的维持治疗，以防止急性发作（A对）。